下列叙述错误的是
A. 腹、盆腔脏器均位于腹膜腔之内
B. 腹、盆腔脏器均位于腹膜腔之外
C. 腹、盆腔脏器均位于腹腔之内
D. 腹膜腔和腹腔是两个不同的概念
E. 无

正确答案：A。腹、盆腔脏器均位于腹膜腔之内

解析：腹膜腔和腹腔在解剖学上是两个不同的概念（D对），腹腔是指膈以下、小骨盆上口以上,由腹壁围成的腔,广义的腹腔包括小骨盆腔在内，所以腹、盆腔脏器均位于腹腔之内（C对），腹膜腔则指脏腹膜和壁腹膜之间的潜在性腔隙,腔内仅含少量浆液，所以腹、盆腔脏器均位于腹膜腔之外（B对，故A为本题正确答案）。